不属于抑制胃酸分泌的抗溃疡药物是
A. 西咪替丁
B. 哌仑西平
C. 三硅酸镁
D. 奥美拉唑
E. 丙谷胺

正确答案：C。三硅酸镁